下列不属于双面嵌体的是
A. 远中（牙合）嵌体
B. 颊（牙合）嵌体
C. 近中（牙合）远中嵌体
D. 舌（牙合）嵌体
E. 近中（牙合）嵌体

正确答案：C。近中（牙合）远中嵌体

解析：本题考查嵌体的种类-双面嵌体。不属于双面嵌体的是近中（牙合）远中嵌体（C错，为本题的正确答案）。嵌体根据覆盖牙面的不同，分为单面嵌体、双面嵌体和多面嵌体。近中（牙合）远中嵌体由于涉及三个牙面，属于多面嵌体。双面嵌体是指嵌体涉及了两个牙面，包括近中（牙合）嵌体（E对）、远中（牙合）嵌体（A对）、颊（牙合）嵌体（B对）、舌（牙合）嵌体（D对）等。